地方性疾病主要是指
A. 区域内的传染病
B. 自然疫源性疾病
C. 地质环境因素引起的疾病
D. 环境公害病
E. 种族遗传性疾病

正确答案：C。地质环境因素引起的疾病

解析：本题考查地方性疾病。地方性疾病一般指地方病，是指具有地区性发病特点的一类疾病。地方病往往只发生在某一特定地区，同一定的自然环境因素有密切的关系（C对ABDE错），如地质、地貌、水质、气候、食物、居住条件等。